痢疾杆菌按国际分类法可分为几个群
A. 2个群
B. 3个群
C. 4个群
D. 5个群
E. 6个群

正确答案：C。4个群